在统计样本数据时，样本率与总体率、各样本率之间往往会有差异，这种差异被称为率的抽样误差。率的抽样误差表示
A. 方差的标准误
B. 率的标准查
C. 乘积的标准误
D. 率的平均值
E. 率的标准误

正确答案：E。率的标准误

解析：从同一个总体中随机抽出观察数相等的多个样本，样本率与总体率、各样本率之间往往会有差异，这种差异被称为率的抽样误差。率的抽样误差用率的标准误表示。掌握“分类资料的统计描述与推断”知识点。